糖尿病患者调养中哪一项是错误的
A. 控制运动
B. 控制摄入总热量
C. 适当限制碳水化合物，脂肪，保证必要蛋白质
D. 适当限盐
E. 戒酒

正确答案：A。控制运动

解析：糖尿病患者多运动有助于减轻体重、改善胰岛素的敏感性、降低体内炎症因子水平、改善脂肪和蛋白质代谢（A错，为本题正确答案））；糖尿病患者需控制摄入总热量（B对）；糖尿病的膳食结构为高碳水化合物、低脂肪、低蛋白、高纤维膳食（C对）并需控制摄入总热量（每日食盐摄入应在6g以下，特别是高血压病人尤应限盐（D对）；此外，还应限制饮酒（E对）。